影响神经递质释放并直接激动α₁受体的药物是
A. 间羟胺
B. 维拉帕米
C. 氟尿嘧啶
D. 奥美拉唑
E. 异丙肾上腺素

正确答案：A。间羟胺